关于苷类化合物的说法，正确的是
A. 结构中均有糖基
B. 可发生酶水解反应
C. 大多具有挥发性
D. 可发生酸水解反应
E. 大多具有升华性

正确答案：A、B、D。结构中均有糖基；可发生酶水解反应；可发生酸水解反应

解析：本题考查的是苷类化合物的特点。关于苷类化合物的说法，正确的是结构中均有糖基（A对）、可发生酶水解反应（B对）与可发生酸水解反应（D对）。苷类，即配糖体，是糖或糖的衍生物如氨基糖、糖醛酸等与另一非糖物质通过糖的端基碳原子连接而成的化合物。氰苷容易水解，尤其有酸和酶催化时水解更快。大多具有挥发性（C错）与大多具有升华性（E错）为分子量小的香豆素的性状。香豆素中分子量小的有挥发性，能随水蒸气蒸馏，并能升华。